采用病例对照研究方法探索饮酒与男性早发性痴呆之间的关系，考虑吸烟是潜在的混杂因素，如果进行分层分析，则分层因素是
A. 饮酒
B. 患病情况
C. 吸烟
D. 性别
E. 年龄

正确答案：C。吸烟

解析：本题考查分层分析的相关内容。分层分析是根据潜在混杂因素的有无或程度将研究对象分为不同的层，然后在各层中比较病例组和对照组暴露因素的分布。本题中考虑吸烟是潜在的混杂因素，如果进行分层分析，则分层因素是吸烟（C对ABDE错）。